《中国药典》规定，含量测定的指标成分属于香豆素类化合物的中药有
A. 秦皮
B. 陈皮
C. 前胡
D. 补骨脂
E. 五味子

正确答案：A、C、D。秦皮；前胡；补骨脂

解析：本题考查的是含量测定的指标成分属于香豆素类化合物的中药。《中国药典》规定，含量测定的指标成分属于香豆素类化合物的中药有秦皮（A对）、前胡（C对）和补骨脂（D对）。香豆素是邻羟基桂皮酸的内酯，广泛分布于高等植物中，尤其以芸香科和伞形科为多，少数发现于动物和微生物中。在植物体内，它们往往以游离状态或与糖结合成苷的形式存在。含香豆素类化合物的常用中药有秦皮、前胡、肿节风、补骨脂等。秦皮中主要含七叶内酯（秦皮乙素）和七叶苷（秦皮甲素），《中国药典》则采用高效液相色谱法并规定本品按干燥品计，含秦皮甲素、秦皮乙素的总量不得少于1.0%。前胡的主要化学成分为香豆素化合物，《中国药典》采用高效液相色谱法测定药材中白花前胡甲素和白花前胡乙素含量，其中白花前胡甲素含量不少于0.90%，白花前胡乙素不少于0.24%。补骨脂含有多种香豆素类成分，包括补骨脂内酯（补骨脂素）、异补骨脂内酯（异补骨脂素）和补骨脂次素等。《中国药典》采用高效液相色谱法测定药材中补骨脂素和异补骨脂素含量，两者总量不得少于0.70%。陈皮（B错）的含量测定的指标成分为黄酮类化合物。陈皮中除含挥发油外，还含有多种黄酮类化合物，其中橙皮苷多制成甲基橙皮苷供药用，是治疗冠心病药物“脉通”的重要原料之一。《中国药典》以橙皮苷为指标成分对陈皮进行含量测定。要求陈皮中橙皮苷含量不得少于3.5%；广陈皮中橙皮苷含量不得少于2.0%，对广陈皮，另外要求测定川陈皮素和橘皮素的总量，总量不得少于0.42%。五味子（E错）的含量测定的指标成分为木脂素。五味子中含木脂素较多，约为5%。《中国药典》采用高效液相色谱法测定药材中五味子醇甲的含量，要求不得少于0.40%。